新生儿败血症的产前感染的途径是
A. 孕母有菌血症
B. 阴道细菌上行
C. 脐部感染
D. 消化道入侵
E. 黏膜破损

正确答案：A。孕母有菌血症

解析：新生儿的感染可以发生在出生前，病原体可由母亲血流经过胎盘感染胎儿，是最常见的感染途径，又称宫内感染，但宫内感染的胎儿多流产、死胎、死产、胎儿宫内发育迟缓、先天畸形及婴儿出生后肝脾肿大、黄疸、贫血、血小板减少以及神经系统受损等多器官功能损害，即“宫内感染综合症”；也可因母亲的菌血症（A对）、泌尿系统的细菌上行感染羊膜（B错），胎儿误吸入污染的羊水，或羊膜穿刺等有创性操作而消毒又不严导致胎儿感染。脐部感染（C错）、消化道入侵（D错）和粘膜破损（E错）均属于产后感染的范畴。